处于小康水平的居民Engel指数为
A. ≥60%
B. 50%～59%
C. 40%～49%
D. 30%～39%
E. ＜30%

正确答案：C。40%～49%

解析：本题考查处于小康水平的居民Engel指数。Engel指数是指食物支出占家庭总收入的比重，Engel指数＝用于食品的开支/家庭总收入×100%，它是衡量一个国家或地区居民消费水平的标志，是反映贫困富裕的指标。该指数在60%以上（A错）者为贫困，50%～59%（B错）为勉强度日，40%～49%（C对）为小康水平，30%～39%（D错）为富裕，30%以下（E错）为最富裕。